染色血涂片中靴形红细胞增多见于
A. 失血性贫血
B. 溶血性贫血
C. 恶性贫血
D. 地中海贫血
E. 再生障碍性贫血

正确答案：D。地中海贫血